男性第二性征发育不包括
A. 阴毛
B. 腋毛
C. 胡须
D. 变声
E. 睾丸增大

正确答案：E。睾丸增大

解析：本题考查男性的第二性征发育。男性第二性征的发育主要是指除外生殖器以外的发育，不包括睾丸增大（E错，为本题正确答案）。它主要表现为: 1、皮肤黏膜增厚、肌肉组织增强，而表现为身高力强等表现。2、表现为喉结增大、声音嘶哑，由童声而逐渐转变为低沉的嗓音（D对）。3、随着雄激素进一步的增多，出现有胡须（C对），出现阴毛（A对）、腋毛（B对）等表现。4、可表现为乳房发育，但这种发育非常轻微，可以表现为乳晕扩大。